男，56岁。阵发性胸痛10天，每次发作持续10分钟左右，运动可诱发。近1周胸痛发作频率增加，休息时亦可有发作。有陈旧心肌梗死病史。该患者暂时不宜做的检查是
A. 心电图
B. 超声心动图
C. 动态心电图
D. 冠状动脉造影
E. 心电图负荷试验

正确答案：E。心电图负荷试验

解析：患者原有心肌梗死病史，现阵发性胸痛10天，持续10分钟，运动可诱发，表明患者此时应为稳定型心绞痛，近一周频率增加，休息时亦有发作，提示稳定型心绞痛可能已转化为不稳定型心绞痛，不稳定型心绞痛是心电图负荷试验的禁忌症之一（E错，为本题正确答案）。心电图（A对）有助于心绞痛的诊断，属于必要检查之一。超声心动图（P222）（B对）可测定左室功能，并有助于与其他会出现胸痛疾病如梗阻性肥厚型心肌病、主动脉瓣狭窄的鉴别，有助于本病的辅助诊断。动态心电图（P180）（C对）可以连续记录患者24小时的心电图，有助于明确心肌缺血与日常活动之间的关系以及昼夜分布特征，对本病的诊断亦有帮助。冠状动脉造影（P222）（D对）对于冠心病的诊断有重要意义，是冠心病检查的金标准，对于明确本例患者的诊断帮助极大。